细菌感染患者可出现
A. 红细胞/血红蛋白减少
B. 中性粒细胞增多
C. 嗜酸性粒细胞增多
D. 血小板增多
E. 嗜碱性粒细胞减少

正确答案：B。中性粒细胞增多

解析：本题考查细菌感染。细菌感染患者可出现中性粒细胞增多（B对）。急性感染，如细菌、某些病毒、真菌、螺旋体等感染时白细胞（中性粒细胞）增加。红细胞/血红蛋白减少（A错）见于消化道溃疡、再生障碍性贫血、骨髓瘤等。嗜酸性粒细胞增多（C错）见于支气管哮喘、荨麻疹、湿疹、慢性粒细胞白血病、嗜酸性粒细胞白血病、猩红热、风湿性疾病等。血小板增多（D错）见于慢性粒细胞白血病、真性红细胞增多症、急性感染、急性溶血等。嗜碱性粒细胞减少（E错）见于过敏性休克、促肾上腺皮质激素、肾上腺皮质激素应用过量及应激反应。